以下对大众传播特点的描述正确的是
A. 传播者是职业性的传播机构和人员
B. 受众明确，针对性强
C. 反馈及时，沟通充分
D. 不需借助非自然的传播技术手段
E. 对态度和行为改变的效果强于人际传播

正确答案：A。传播者是职业性的传播机构和人员